我国已制定的《国家突发公共卫生事件应急预案》主要内容不包括
A. 应急组织体系及职责
B. 突发公共卫生事件的监测、预警与报告
C. 突发公共卫生事件应急处置的保障
D. 常规性疾病预防控制
E. 突发公共卫生事件的应急反应和终止

正确答案：D。常规性疾病预防控制

解析：我国已制定了《国家突发公共卫生事件应急预案》主要内容包括：①应急组织体系及职责；②突发公共卫生事件的监测、预警与报告；③突发公共卫生事件的应急反应和终止；④善后处理；⑤突发公共卫生事件应急处置的保障；⑥预案管理与更新。掌握“突发公共卫生事件”知识点。